肠干注入
A. 左静脉角
B. 右静脉角
C. 乳糜池
D. 右颈干
E. 无

正确答案：C。乳糜池

解析：胸导管注入左静脉角（A错），右淋巴导管注入右静脉角（B错），肠干及左、右腰干注入乳糜池（C对）进而连接胸导管。